向邻近的多个毛囊及其周围皮肤附属器的急性化脓性炎症感染属于
A. 疖
B. 痈
C. 丹毒
D. 脓肿
E. 结核

正确答案：B。痈

解析：痈指邻近的多个毛囊及其周围组织的急性化脓性感染，也可由多个疖融合而成。掌握“软组织急性感染”知识点。